我国对克隆技术是否应该用于人类的立场是
A. 允许治疗性克隆，不允许生殖性克隆
B. 不允许治疗性克隆，允许生殖性克隆
C. 允许一切克隆
D. 不允许一切克隆
E. 以上都不是

正确答案：A。允许治疗性克隆，不允许生殖性克隆